左心衰竭时发生瘀血的器官是
A. 肝
B. 肺
C. 肾
D. 脑
E. 脾

正确答案：B。肺